酪氨酸蛋白激酶活性受体的配体
A. 线粒体
B. 细胞膜
C. 基因
D. 酶
E. 某些生长因子

正确答案：E。某些生长因子

解析：酶偶联受体（包括丝裂原激活的蛋白激酶受体和酪氨酸蛋白激酶受体等）主要是生长因子（E对）和细胞因子的受体，此类受体介导的信号转导主要是调节蛋白质的功能和表达水平、调节细胞增殖和分化。离子通道型受体的配体主要为神经递质，G蛋白偶联受体的配体为神经递质、激素、趋化因子、外源刺激（味、光）等。